患者近期出现双手关节肿胀、疼痛，伴晨僵诊断为类风湿性关节炎，应选的药物是
A. 对乙酰氨基酚片
B. 芬太尼透皮贴
C. 羟考酮缓释片
D. 卡马西平片
E. 塞来昔布胶囊

正确答案：E。塞来昔布胶囊

解析：本题考查治疗类风湿性关节炎的药物。塞来昔布胶囊（E对）属于选择性COX-2抑制剂类非甾体抗炎药，用于类风湿性关节炎。对乙酰氨基酚片（A错）为乙酰苯胺类非甾体抗炎药，是缓解轻中度骨性关节炎疼痛的首选药。芬太尼透皮贴（B错）为合成阿片类镇痛药，用于麻醉前、中、后的镇静与镇痛，是目前复合全麻中常用的药物。羟考酮缓释片（C错）为镇痛药，用于缓解持续的中、重度疼痛。卡马西平片（D错）为二苯并氮䓬类药物，用于治疗癫痫、躁狂症、三叉神经痛、带状疱疹所致的严重后遗神经痛等。